治疗支原体肺炎宜选用
A. 两性霉素
B. 苯唑西林
C. 利巴韦林
D. 阿奇霉素
E. 阿莫西林/克拉维酸钾

正确答案：D。阿奇霉素

解析：本题考查阿奇霉素。阿奇霉素（D对）为大环内酯类抗生素，可治疗支原体肺炎。两性霉素（A错）为抗真菌药。苯唑西林（B错）属于耐酶的β-内酰胺类抗生素。利巴韦林（C错）为抗病毒药。阿莫西林/克拉维酸钾（E错）用于治疗流感嗜血杆菌引起的肺炎。